拒绝违法的指令，抵制违法行为，维护病患者的健康利益和其他合法权益，是
A. 执业药师的责任
B. 执业药师的权力
C. 执业药师的义务
D. 执业药师的权利
E. 执业药师的执业行为规范

正确答案：C。执业药师的义务